糖皮质激素的使用原则是
A. 起始足量，快速减药，长期维持
B. 逐渐加量，缓慢减药，长期维持
C. 起始足量，缓慢减药，短期维持
D. 逐渐加量，快速减药，短期维持
E. 起始足量，缓慢减药，长期维持

正确答案：E。起始足量，缓慢减药，长期维持

解析：长期应用激素的患者容易发生感染、药物性糖尿病、骨质疏松等不良反应，少数病例还可能发生股骨头无菌性缺血性坏死。因此要加强监测，防止不良反应发生，因此在应用激素的过程中要做到起始足量，缓慢减药，长期维持（E对）。